某中年男性，工作压力大，生活不规律，测量血压为150/90mmHg，平素血压不高，此时最合适的处理为
A. 调整生活方式
B. 住院大检查
C. 给与降压药治疗
D. 心理咨询
E. 住院观察

正确答案：A。调整生活方式

解析：患者中年男性，因工作压力大（精神应激）生活不规律引起原发性高血压，平素血压不高，故此时最合适的处理方式为调整生活方式（A对），给与降压药治疗（B错）的对象应该是①高血压2级或以上病人；②高血压合并糖尿病，或者已经有心、脑、肾靶器官损害或并发症病人；③凡血压持续升高，改善生活方式后血压仍未获得有效控制者。该患者属于高血压一级，且未提到有其他病症，故不选择用药。